下列何法为治疗黄疸的重要治则
A. 通便泻热
B. 清泻热邪
C. 祛湿利小便
D. 清热解毒
E. 温化寒湿

正确答案：C。祛湿利小便

解析：因为黄疸的病理因素以湿邪为主，故治疗大法首当化湿，利小便是化湿退黄的途径（C对）。化湿可以退黄，如属湿热，当清热化湿，必要时还应通利腑气，以使湿热下泄；如属寒湿，应予健脾温化。利小便，主要是通过淡渗利湿，达到退黄的目的。正如《金匮要略》所说“诸病黄家，但利其小便”。